下列各项，不属于薄荷的功效是
A. 疏散风热
B. 疏肝行气
C. 清热凉血
D. 透疹利咽
E. 清利头目

正确答案：C。清热凉血

解析：薄荷的功效疏散风热（A对），疏肝行气（B对），利咽透疹（D对），清利头目（E对）。（C错，为本题正确答案）。